流感病人的传染性在下列哪个时期最强
A. 潜伏期
B. 潜伏期末
C. 发病初期
D. 临床症状期
E. 恢复期

正确答案：C。发病初期